影响伤害发生的环境不包括
A. 社会环境
B. 自然环境
C. 生活环境
D. 生产环境
E. 工作环境

正确答案：E。工作环境

解析：本题考查影响伤害发生的环境因素。影响伤害发生的环境因素包括：1.社会环境（A对）：主要强调的是社会支持环境，即一个国家和地区是否有相应的伤害预防的法律、法规及其执行的程度。如驾驶员开车时必须系安全带；摩托车驾驶员必须戴头盔；建筑工人进入工地必须戴安全帽；儿童进入游泳场所必须有成人陪伴等。2.自然环境（B对）：在自然环境中，气象条件是伤害发生的重要影响因素。雨雪天是交通事故的多发时间；浓雾或市雾天极易造成撞车事故；天气长期干燥，易发生火灾；气压低或潮湿闷热天气，会使人疲乏，是工伤多发的时期等。3.生产环境（D对）：在生产环境中，安全防护设施、生产管理水平、劳动时间、强度及操作规范都是影响伤害发生的因素。4.生活环境（C对）：生活环境最容易被忽视，但对伤害的发生却有重要影响。如居室装修时未采用防滑地面易导致跌倒。工作环境（E错，为本题正确答案）不属于影响伤害发生的环境因素。